下列哪项不属于细菌的代谢产物
A. 热原质
B. 毒素
C. 维生素、色素
D. 抗生素、细菌素
E. 纤维素

正确答案：E。纤维素

解析：本题考查细菌的代谢产物。纤维素（E错，为本题的正确答案）是植物细胞壁的主要结构成分，是一种重要的膳食纤维，是自然界中分布最广、含量最多的一种多糖。细菌的代谢产物包括：1.热原质（A对）；2.毒素（B对）与侵袭性酶；3.色素；4.抗生素；5.细菌素（D对）；6.维生素（C对）。